关于抗感染免疫的叙述，下列错误的是
A. 完整的皮肤与黏膜屏障是抗感染的第一道防线
B. 吞噬细胞和体液中的杀菌物质是抗感染的第二道防线
C. 体液免疫主要针对胞外寄生菌的感染
D. 细胞免疫主要针对胞内寄生菌的感染
E. 抗体与细菌结合可直接杀死病原菌

正确答案：E。抗体与细菌结合可直接杀死病原菌